关于月经的临床表现，下列哪项是错误的
A. 正常月经呈鲜红色，易凝固
B. 出血第一日为月经周期开始
C. 月经周期是相邻两次月经第一日的间隔时间
D. 初潮的迟早主要受遗传因素控制
E. 超过80ml称为月经过多

正确答案：A。正常月经呈鲜红色，易凝固

解析：月经血呈暗红色，由于纤维蛋白溶酶对纤维蛋白的溶解作用，月经血不凝。出血多时可出现血凝块。出血第一日为月经周期开始，相邻两次月经第一日的间隔时间，称为一个月经周期。一般为21～35日，平均28日。一次月经总失血量称为经量，正常经量20～60ml，超过80ml称为月经过多。掌握“女性生殖系统生理”知识点。